头面部痛、温觉传导路，第1级神经元在
A. 三叉神经脊束核
B. 三叉神经节
C. 三叉神经脑桥核
D. 斜方体
E. 丘脑中央辐射

正确答案：B。三叉神经节

解析：头面部痛、温觉传导路，第1级神经元在三叉神经节内假单极神经元（B对）。第2级神经元的胞体在三叉神经脊束核（A错）和三叉神经脑桥核（C错）。